下列有关氧化磷酸化的叙述，错误的是
A. 物质在氧化时伴有ADP磷酸化生成ATP的过程
B. 氧化磷酸化过程涉及两种呼吸链
C. 电子分别经两种呼吸链传递至氧，均产生3分子ATP
D. 氧化磷酸化过程存在于线粒体
E. 氧化与磷酸化过程通过偶联产能

正确答案：C。电子分别经两种呼吸链传递至氧，均产生3分子ATP

解析：电子分别经两种呼吸链传递至氧，一种是通过NADH氧化呼吸链传递，P/O比值接近2.5，生成2.5分子的ATP，另一种是通过FADH2氧化呼吸链传递，P/O比值接近1.5，生成1.5分子的ATP，因此两条呼吸链并非均产生3个ATP（C错，为本题正确答案）。同时氧化磷酸化过程同样涉及以上两种两种呼吸链（B对）。真核细胞的氧化磷酸化主要是在线粒体中进行的（D对）。氢经线粒体氧化呼吸链电子传递释放能量，同时与ADP磷酸化生成ATP相偶联，在氧化时伴有P磷酸化生成TP，通过偶联共同产能（AE对）。